23岁，女性，妊娠32周，腹部撞击后，持续性腹痛，少量出血，既往产检健康，脉搏100次/分，呼吸22/分，血压90/60mmHg，痛苦表情，宫底位于剑突下3横指，子宫轮廓清楚，胎心102次/分，宫口未开。可能的诊断
A. 前置胎盘
B. 胎盘早剥
C. 早产临产
D. 巨大胎儿
E. 子宫破裂

正确答案：B。胎盘早剥

解析：青年女性患者，妊娠32周，腹部撞击后（外伤史，常见病因），持续性腹痛，少量出血（胎盘早剥常见表现），既往产检健康，脉搏100次/分，呼吸22/分，血压90/60mmHg（提示病情严重，处于休克状态），痛苦表情，宫底位于剑突下3横指（妊娠32周正常体征），子宫轮廓清楚，胎心102次/分，宫口未开，结合患者的症状、体征，考虑可能的诊断为胎盘早剥（B对）。前置胎盘（A错）一般典型症状为妊娠晚期或临产后发生无诱因、无痛性反复阴道流血。早产临产（C错）是指妊娠达到28周，但不足37周的分娩者，一般表现为子宫收缩伴有少许阴道流血或血性分泌物。巨大胎儿（D错）指任何孕周胎儿体重超过4000g，一般于出生后方可确诊。子宫破裂（E错）典型表现为伴随着撕裂样疼痛，宫缩突然停止。